经典途径中，激活补体能力最强的免疫球蛋白是
A. IgG
B. IgE
C. IgA
D. IgM
E. IgD

正确答案：D。IgM